尿中白细胞增多常见于
A. 泌尿系统感染
B. 慢性肾盂肾炎
C. 前列腺炎
D. 挤压综合征
E. 膀胱炎

正确答案：A、B、C、E。泌尿系统感染；慢性肾盂肾炎；前列腺炎；膀胱炎

解析：本题考查的是尿中白细胞增多的临床意义。尿中白细胞增多常见于泌尿系统感染（A对）、慢性肾盂肾炎（B对）、前列腺炎（C对）与膀胱炎（E对）。正常成人的尿液中可有少数白细胞，超过一定数量时则为异常。白细胞尿中多为炎症感染时出现的中性粒细胞，已发生退行性改变，又称为脓细胞。尿中白细胞增多见于泌尿系统感染、慢性肾盂肾炎、膀胱炎、前列腺炎等。女性白带混入尿液时，也可发现较多的白细胞。挤压综合征（D错），2022年考试指南未明确说明。